男性，38岁，患肝硬化3年。一周来畏寒发热，体温38℃左右，全腹痛，腹部明显膨胀，尿量500mL/d。住院后经检查有以下体征，对目前病情判断最具有意义的是
A. 蜘蛛痣及肝掌
B. 腹壁静脉曲张呈海蛇头样
C. 脾大
D. 全腹压痛及反跳痛
E. 腹部移动性浊音阳性

正确答案：D。全腹压痛及反跳痛

解析：本例患者为肝硬化患者，近期突然发热，出现腹痛、腹部明显膨胀，提示可能出现自发性细菌性腹膜炎。自发性细菌性腹膜炎体格检查时可发现轻重不等的全腹压痛和腹膜刺激征，故对该患者目前病情判断最具有意义的是全腹压痛及反跳痛（D对）。蜘蛛痣及肝掌（A错）、腹壁静脉曲张呈海蛇头样（B错）、脾大（C错）、腹部移动性浊音阳性（E错）主要反映门静脉高压的进展情况，对该患者目前腹膜炎的病情判断没有意义。